提取挥发油常用的方法是
A. 纸色谱法
B. 离子交换法
C. 水蒸气蒸馏法
D. 柱色谱法
E. 薄层色谱法

正确答案：C。水蒸气蒸馏法

解析：本题考查的是挥发油的提取方法。提取挥发油常用的方法是水蒸气蒸馏法（C对）。挥发油也称精油，是存在于植物体内的一类可随水蒸气蒸馏、与水不相混溶的挥发性油状液体。水蒸气蒸馏法：适用于具有挥发性的、能随水蒸气蒸馏而不被破坏，且难溶或不溶于水的化学成分的提取。此类化合物的沸点多在100℃以上，并在100℃左右有一定的蒸气压。纸色谱法（A错）与薄层色谱法（E错）属于色谱法。色谱法是鉴定结晶纯度的一种常用方法。常用的色谱法有纸色谱、纸上电泳和薄层色谱。纸色谱法实质上也是液液萃取法的原理，只是两相中其中一相以固态为基质，与某种液相形成饱和状态，进而达到分离的目的。离子交换法（B错）：离子色谱法是根据物质解离程度不同进行分离。离子色谱法也称离子交换法，该法系以离子交换树脂作为固定相，以水或含水溶剂作为流动相。柱色谱法（D错）：柱色谱可分为分配柱色谱和吸附柱色谱两种原理。高效液相色谱法属于柱色谱法。